发汗不解，腹满痛者，治宜选用
A. 白虎汤
B. 白虎加人参汤
C. 大承气汤
D. 小承气汤
E. 调胃承气汤

正确答案：C。大承气汤

解析：阳明腑实之势急者，治当急下。伤寒发汗不解，即出现腹满痛者，可能因发汗不当，邪气入里，化燥成实所致。所谓腹满痛者，一者言其症状，既痛且满，二者言其范围，满腹皆痛，知阳明燥结程度较重。伤寒汗后迅速出现如此重的阳明腑实证，其燥结速度不可谓不快，必须当机立断，用大承气汤（C对）釜底抽薪，泻下燥结，方能保全阴津，否则目中不了了，睛不和等阴津大伤之症便会接踵而来。